下列关于青蒿素的正确叙述有
A. 对红细胞内期裂殖体有强大而迅速的杀灭作用
B. 对耐氯喹虫株感染有良好疗效
C. 最大缺点是复发率高
D. 动物实验大剂量时，曾发现骨髓抑制、肝损害、胚胎毒性
E. 用于病因性预防

正确答案：A、B、C、D。对红细胞内期裂殖体有强大而迅速的杀灭作用；对耐氯喹虫株感染有良好疗效；最大缺点是复发率高；动物实验大剂量时，曾发现骨髓抑制、肝损害、胚胎毒性

解析：本题考查青蒿素。青蒿素抗疟疾作用机理主要在于在治疗疟疾的过程中通过青蒿素活化产生自由基，自由基与疟原蛋白结合，作用于疟原虫的膜系结构，使其泡膜、核膜以及质膜均遭到破坏，线粒体肿胀，内外膜脱落，从而对疟原虫的细胞结构及其功能造成破坏，且细胞核内的染色质也受到一定的影响。对红细胞内期疟原虫有强大的杀灭作用（A对），对红细胞外期疟原虫无效。其体内代谢较快，有效血浆药物浓度维持时间短，不利于彻底杀灭疟原虫，故复发率较高（C对）。临床用于控制间日疟和恶性疟的症状，对耐氯喹虫株也有良好疗效（B对）。动物实验大剂量时，曾发现骨髓抑制、肝损害、胚胎毒性（D对）。乙胺嘧啶用于病因性预防，青蒿素无此作用（E错）。